产生过敏反应，需要给抗组胺药和地塞米松进行预防的是
A. 氨氯地平
B. 顺铂
C. 紫杉醇
D. 多柔比星
E. 谷胱甘肽

正确答案：C。紫杉醇

解析：本题考查药物的不良反应。紫杉醇（C对）以特殊溶剂聚乙烯醇蓖麻油进行溶解，可能导致超敏反应，需要给予糖皮质激素、抗组胺药和地塞米松进行预防。氨氯地平（A错）无明显过敏反应。顺铂（B错）过敏反应不及紫杉醇严重，非必要时无需同时给予抗组胺药和糖皮质激素。多柔比星（D错）过敏者禁用。护肝药谷胱甘肽（E错）过敏者禁用。